背侧丘脑内的联络性核团
A. 内侧核.
B. 腹前核
C. 腹外侧核
D. 腹后核
E. 无

正确答案：A。内侧核.

解析：背侧丘脑内的联络性核团包括前核、内侧核（A对）和外侧核的背侧组。腹前核（B错）、腹外侧核（C错）、腹后核（D错）均属于背侧丘脑内的特异性中继核团。